患者男，50岁，有心脏病病史8年。此次因劳累受惊后发作症见喘促日久，呼多吸少，动则更甚，形寒神疲，渐至喘促持续不接，张口抬肩，面赤躁扰，汗出如珠，脉浮大无根。查体：双肺可闻及干湿啰音，心率130次/分，心尖区可闻及舒张期奔马率，中医诊断“心衰”，除西药治疗外，治疗首选
A. 参附汤合葶苈大枣泻肺汤
B. 参附汤合五苓散
C. 通脉四逆汤合参附龙牡汤
D. 真武汤合五苓散
E. 圣愈汤合小陷胸汤

正确答案：C。通脉四逆汤合参附龙牡汤

解析：本题患者为心衰，心肾阳虚，心脉失养，则心悸；不能温煦肌肤，则形寒肢冷；心神失养，则乏力。肾气虚极则肾阳亦衰，甚至虚阳浮越欲脱，则见喘息加剧，神疲、汗出如珠、脉浮大无根等症状，宜用通脉四逆汤合参附龙牡汤（C对）；参附汤合葶苈大枣泻肺汤用于阳虚水泛证，症状：心悸征忡，气短喘促，动则尤甚，或端坐而不得卧，精神萎靡，乏力懒动，腰膝酸软，形寒肢冷，面色苍白或晦暗，肢体浮肿，下肢尤甚，甚则腹胀脐突，尿少或夜尿频多，舌淡苔白，脉沉弱或迟（A错）；参附汤合五苓散用于心脏瓣膜病中的心肾阳虚证，症状：心悸，喘息不能平卧，颜面及肢体浮肿，或伴胸水、腹水，脘痞腹胀，形寒肢冷，大便溏泻，小便短少，舌体胖大，质淡，苔薄白，脉沉细无力或结代（B错）；真武汤合五苓散用于阳虚水泛证，证状：面浮，下肢肿，甚则一身悉肿，腹部胀满，心悸，咳喘，咳痰清稀，纳差，尿少，怕冷，面唇青紫，舌胖质黯，苔白滑，脉沉细（D错）；圣愈汤合小陷胸汤用于治疗痰热互结证，症见心悸气短，局部肿块刺痛，肢体麻木，胸闷痰多，或痰中带紫暗血块，舌紫暗或有斑点，苔腻，脉弦涩（E错）。